下列对华法林作用的描述，错误的是
A. 防止静脉血栓栓塞
B. 可用于播散性血管内凝血
C. 防止外周动脉血栓栓塞
D. 降低肺栓塞的发病率
E. 心肌梗死辅助用药

正确答案：B。可用于播散性血管内凝血

解析：华法林属于香豆素类抗凝药，为维生素K的拮抗药，能抑制肝脏的维生素K环氧还原酶，阻止维生素K的环氧型向氢醌型的转变，从而阻碍维生素K的再利用，影响凝血因子Ⅱ、Ⅶ、Ⅸ、Ⅹ的γ羧化，阻止了其活化，产生抗凝作用，体外无抗凝作用，只能抑制凝血因子的合成，对已经合成的凝血因子无抑制作用，需待凝血因子耗竭后才出现疗效，故起效缓慢，不适用于播散性血管内凝血（B错，为本题正确答案），而应用肝素代替。华法林临床用于血栓栓塞性疾病，如静脉血栓栓塞（A对）、外周动脉血栓栓塞（C对）、心房纤颤伴有附壁血栓、肺栓塞（D对）、心脏外科手术和冠状动脉闭塞等；还可用于心肌梗死的辅助用药（E对）；亦用于风湿心脏病、髋关节固定术、人工置换心脏瓣膜手术后防止静脉血栓的发生。